全口义齿初戴时，给患者医嘱中错误的是
A. 初戴有异物感，恶心，发音不清，但会逐渐好转
B. 每次饭后需清洗义齿
C. 夜间不能戴用义齿
D. 出现疼痛后，应及时到医院复诊
E. 不戴时应泡在冷水中

正确答案：C。夜间不能戴用义齿

解析：本题考查给患者的戴牙指导。全口义齿初戴时，给患者医嘱中错误的是夜间不能戴用义齿（C错，为本题的正确答案）。建议夜间将义齿摘下浸泡于冷水中，可以让无牙颌承托区组织得到适当休息，利于组织健康，但不是“夜间不能戴用”。全口义齿初戴时，由于长时间缺牙，患者会有不适，异物感，恶心，发音不清等问题，但随着对义齿的适应会逐渐好转（A对）。每次饭后清洗义齿（B对）有利于口腔组织健康，也是对义齿的保护。义齿不戴时应泡在冷水中（E对），不要长时间暴露于干燥环境，义齿会变性。戴用义齿是个逐渐适应的过程，中间出现疼痛等问题要及时复诊（D对），以便保护口腔组织的健康和功能的恢复。